某铸造工人，接触粉尘作业30年，因咳嗽、气短胸闷、胸痛而到医院诊治，医师怀疑他患硅沉着病。本病例如确诊为硅沉着病，其安置原则是
A. 可继续从事接尘作业但每年复查一次
B. 暂时从事接尘作业但每年复查一次
C. 暂时从事接尘作业但每半年复查一次
D. 调离接尘作业
E. 由于病例的硅沉着病分期不详而无法决定

正确答案：D。调离接尘作业